谷皮中不含有
A. 淀粉
B. 脂肪
C. 灰分
D. 纤维素
E. 蛋白质

正确答案：A。淀粉